下列哪项反射活动中存在着正反馈
A. 腱反射
B. 排尿反射
C. 减压反射
D. 肺牵张反射
E. 对侧伸肌反射

正确答案：B。排尿反射